患者，女，38岁。突然恶寒发热，小腿皮肤红赤，灼热肿胀，迅速扩大，鲜红成片，稍高起皮肤，界线清楚。其诊断是
A. 发
B. 痈
C. 丹毒
D. 有头疽
E. 疖

正确答案：C。丹毒

解析：丹毒是患部皮肤突然发红成片、色如涂丹的急性感染性疾病。该患者以小腿皮肤红肿疼痛，皮色鲜红，色如涂丹，边界清楚为主要临床表现，诊断为丹毒，发病部位以小腿为主，又称流火（C对）。发，是病变范围较痈大的急性化脓性疾病，相当于西医的蜂窝织炎，其特点是初起无头、红肿蔓延成片，中央明显，四周较淡，边界不清，灼热疼痛，有的3～5日后中央色褐腐溃，周围湿烂，全身症状明显，本病例皮损特点与之不符（A错）。痈，是指发生于体表肌肉之间的急性化脓性疾病，相当于西医的皮肤浅表脓肿、急性化脓性淋巴结炎，其特点是局部光软无头，红肿疼痛，结块范围多在6～9cm左右，发病迅速，易肿、易脓、易溃、易敛，或伴有恶寒、发热、口渴等全身症状，一般不会损伤筋骨，也不易造成内陷，本病例皮损特点与之不符（B错）。有头疽，是发生于肌肤间的急性化脓性疾病，相当于西医的痈，其特点是初起皮肤上即有粟粒样脓头，焮热红肿胀痛，迅速向深部及周围扩散，脓头相继增多，溃后状如莲蓬、蜂窝，范围常超过9～12cm，本病例皮损特点与之不符（D错）。疖，是指发生于肌肤浅表部位、范围较小的急性化脓性疾病，相当于西医的疖、头皮穿凿性脓肿、疖病，其特点是肿势局限，范围多小于3cm，突起根浅，色红、灼热、疼痛，易脓、易溃、易敛，本病例皮损特点与之不符（E错）。